缩窄性心包炎，多表现为
A. 脉搏短绌
B. 水冲脉
C. 奇脉
D. 颈静脉搏动
E. 交替脉

正确答案：C。奇脉

解析：奇脉常见于心包积液和缩窄性心包炎时，是心包填塞的重要体征之一（C对）。脉搏短绌见于心房纤维颤动（房颤）（A错）。水冲脉常见于主动脉瓣关闭不全、发热、甲亢、严重贫血 、动脉导管未闭等（B错）。颈静脉怒张，提示颈静脉压增高，见于右心衰竭、缩窄性心包炎、心包积液及上腔静脉阻塞综合征。其他如情绪激动、用力等导致胸腔或腹腔压力增高时也可见颈静脉怒张（D错）。交替脉是左心室衰竭的重要体征。见于高血压心脏病、急性心肌梗死或主动脉瓣关闭不全等（E错）。